多用于抑郁症的药物是
A. 酚噻嗪类药物
B. 抑制5-HT再摄取的药物
C. 苯二氮草类药物
D. 锂盐
E. 卡马西平

正确答案：B。抑制5-HT再摄取的药物

解析：抑制5-HT再摄取的药物通过增加突触间隙的5-HT而发挥抗抑郁作用，是抗抑郁药物（B对）。吩噻嗪类药物（A错）（P142）是抗精神病药物，多用于精神分裂症。苯二氮草类药物（C错）（P117）主要用于焦虑症、失眠症、癫痫。锂盐（D错）（P148）主要用于抗躁狂但有时对抑郁症也有效，有情绪稳定剂。卡马西平（E错）（P125）是广谱抗癫痫药，是治疗单纯性局限性发作和大发作的首选药之一，同时还有抗复合性局限性发作和小发作的作用。